经产妇，足月活胎可经阴道娩出的胎位是
A. 枕右后位
B. 肩左后位
C. 肩右后位
D. 颏左后位
E. 颏右后位

正确答案：A。枕右后位

解析：枕右后位者（A对），取左侧俯卧位，左腿后伸，右腿屈曲于腹前，使胎背依靠重力作用沿较短途径旋转至枕前位，足月活胎可经阴道娩出。颏后位（DE错）时，若能向前内旋转135°，可以颏前位娩出；若内旋转受阻，成为持续性颏后位，足月活胎不能经阴道自然娩出。以肩胛骨为指示点，有肩左前、肩左后（B错），肩右前、肩右后（C错）4种胎位，是最不利于分娩的胎位，除死胎及早产儿胎体可折叠而自然娩出外，足月活胎不可能经阴道自然娩出。